女性，45岁，幽门梗阻行持续胃肠减压半月余，每日补10%葡萄糖2500ml，5%葡萄糖盐水1000ml，10%氯化钾30ml。2天前开始出现全腹膨胀，无压痛及反跳痛，肠鸣音消失，每日尿量1500ml左右，最可能的原因是
A. 低钾血症
B. 低钠血症
C. 高钾血症
D. 高钠血症
E. 低钙血症

正确答案：A。低钾血症

解析：患者由于持续胃肠减压导致大量体液丢失，每日补充10％氯化钾30ml后出现全腹膨胀，肠鸣音消失，最可能原因应为低钾血症（A对）。患者持续胃肠减压，钾随体液大量丢失，而每日仅补充10％氯化钾30ml，即3g氯化钾（30ml×0.1＝３ｇ），处于要求补充量3～6g的低限，易导致低钾血症而出现腹胀、肠蠕动消失等肠麻痹症状。低钠血症（B错）、高钠血症（D错）和高钾血症（C错）均不会出现腹胀、肠鸣音消失等症状。低钙血症（E错）主要发生在急性重症胰腺炎、肾衰竭和甲状旁腺功能受损等，常表现为手足抽搐、腱反射亢进等神经肌肉兴奋性增高症状。